女，30岁。持续高烧2周，于8月入院。查体：T39.8/℃，脉搏86次/分，神志清楚，表情淡漠，面色苍白，前胸部可见散在红色斑丘疹，脾肋下可及。首先应考虑的诊断是
A. 伤寒
B. 疟疾
C. 斑疹伤寒
D. 肾病综合症出血热
E. 败血症

正确答案：A。伤寒

解析：女性患者，持续高烧2周，体温39.8℃（持续高热），脉搏86次/分，神志清楚，表情淡漠，面色苍白（出现神经系统中毒症状），前胸部可见散在红色斑丘疹（胸部出现玫瑰疹），脾肋下可及（脾肿大），根据患者临床表现和病史，拟诊断为肠热症，首先考虑为伤寒（A对），其病原体为伤寒杆菌。疟疾（B错）是由人类疟原虫感染导致的寄生虫病，临床上以反复发作的间歇性寒战、高热、继之出大汗后缓解为特点，非持续性高热，反复发作造成大量红细胞被破坏，可使患者出现不同程度的贫血和脾肿大，不会出现玫瑰疹（八版传染病学P280）。斑疹伤寒（C错）是包括流行性斑疹伤寒和地方性斑疹伤寒，是由由普氏立克次体和莫氏立克次体感染导致的立克次体病，流行性斑疹伤寒（八版传染病学P134）临床表现全身感染症状比较严重，急性起病，稽留型高热伴寒战、乏力剧烈头痛等全身中毒症状，出现斑丘疹多遍及全身，中枢神经系统症状明显，可有心血管系统症状；地方性斑疹伤寒（八版传染病学P139）临床表现与流行性斑疹伤寒相似，但症状较轻，病程相对短。流行性出血热（肾综合征出血热）（D错）是由汉坦病毒导致的出血热疾病，临床以发热、低血压休克、充血出血和肾损害为主要表现（八版传染病学P77）。败血症（E错）是病原微生物侵入血液循环系统引起的严重毒血症症状的全身感染综合征，临床上主要为寒战、发热、严重毒血症状、皮疹瘀点、肝脾肿大和白细胞数增高等系统性表现（八版传染病学P225-P226）。